硝苯地平属于以下哪类钙离子拮抗剂
A. 非选择性钙拮抗药
B. 二氢吡啶类
C. 苯并噻氮（艹卓）类
D. 苯烷胺类
E. 苯二氮（艹卓）类

正确答案：B。二氢吡啶类

解析：二氢吡啶类：硝苯地平、尼卡地平、尼群地平、氨氯地平、尼莫地平等。掌握“钙通道阻滞药药理作用和不良反应”知识点。